患者女性，60岁，慢性咳喘20年，剧烈咳嗽3天，无咳痰、咯血及发热，半小时前突发胸痛，呼吸困难，不能平卧，伴发绀。体检：血压150/100mmHg，呼吸40次/分。右胸语颤减弱，呼吸音减低。心率110次/分。以上表现符合
A. 肺梗死
B. 急性心肌梗死
C. 自发性气胸
D. 阻塞性肺气肿
E. 反流性食管炎

正确答案：C。自发性气胸

解析：自发性气胸可突然发生胸痛，呼吸困难，胸闷，气管向健侧移位，患侧胸部饱满，呼吸运动减弱或消失，叩诊呈鼓音，语音震颤及呼吸音减弱。严重者烦躁不安、大汗、发绀，呼吸加快，脉搏细速，甚至休克。掌握“气胸”知识点。